正确的正颌外科治疗程序是
A. 制定手术计划+术前正畸+正确施术+术后正畸+追踪观察
B. 术前正畸+制定手术计划+正确施术+术后正畸+追踪观察
C. 术前正畸+制定手术计划+正确施术
D. 制定手术计划+术前正畸+正确施术+术后正畸
E. 前正畸+制定手术计划+正确施术+追踪观察

正确答案：B。术前正畸+制定手术计划+正确施术+术后正畸+追踪观察

解析：本题考查正颌外科的治疗程序。正确的正颌外科治疗程序是术前正畸+制定手术计划+正确施术+术后正畸+追踪观察（B对）。正颌外科的治疗程序如下：一、术前正畸治疗：正颌外科患者术前正畸治疗的目的不是用正畸手段来矫正牙颌畸形，而是为成功施行正颌外科手术做准备的，因此其矫治原则与一般的正畸治疗并不一样；二、正颌外科手术：正确的术前设计和对预定方案的顺利实施是保证手术成功的重要条件；三、术后正畸与康复治疗；四、随访观察：正畸治疗完成后还应仔细观察4～6周，若无复发倾向，再拆除固定矫正器，并制作保持器，稳定治疗效果。治疗结束后最好定期复查。